新生儿期保健
A. 保健的原则是对胎儿有利因素要保证，不利因素要尽量避免和减少
B. 主要保健重点是清理呼吸道，建立呼吸，保温，预防脐带断端、眼和皮肤感染，母乳喂养等
C. 约为10年，是身体和智力发展很快的时期。要加强营养，合理营养，避免儿童期肥胖的发生。避免女童发生外阴阴道炎
D. 是从儿童期末到性成熟期之间的一段生命时期，在此时期内身体和心理发生巨大的变化
E. 是妇女一生中生育和劳动生产的鼎盛时期

正确答案：B。主要保健重点是清理呼吸道，建立呼吸，保温，预防脐带断端、眼和皮肤感染，母乳喂养等

解析：本题考查新生儿期保健的相关内容。新生儿期保健（B对ACDE错）：1.新生儿出生后随即要断脐，断脐后还需护脐，脐部要保持清洁、干燥，防止感染；2.娩出时，咽喉部的羊水不能完全排出，要及时清理呼吸道，建立呼吸，防止引起婴儿窒息；3.注意保温：由于新生儿刚脱离母体，不太适应外界环境，容易出现体温低的现象，应该注意保暖；4.预防感染：由于新生儿的免疫功能不完善，机体抵抗力低，注意婴儿脐带断端、眼及皮肤等敏感部位的预防。